关于哺乳的描述不正确的是
A. 泌乳量少是乳母营养不良的一个指征
B. 婴儿吸吮乳头对乳汁的分泌很重要
C. 乳母严重营养不良将影响乳汁的质量
D. 母亲泌乳量在个体之间差别不大
E. 婴儿体重增长率是判定乳量是否足够的良好指标

正确答案：D。母亲泌乳量在个体之间差别不大

解析：本题考查哺乳的相关内容。母亲泌乳量在个体之间有差别（D错，为本题正确答案），乳母营养状况影响泌乳量。乳母对营养的需求主要用于两个方面，除为满足母体恢复健康的需要外，更重要的是为泌乳提供物质基础。泌乳量少是母亲营养不良的一个表现特征（A对）。通常根据婴儿体重增长率作为奶量是否足够的指标（E对）。婴儿吸吮乳头可刺激乳母垂体产生催乳素，引起乳腺腺泡分泌乳汁（B对）。乳母的营养状况好坏将直接影响乳汁的营养素含量（C对），从而影响婴儿健康状况。